女，45岁。阴道不规则出血2月，出血量不多。妇科检查可见子宫增大，稍软。B超示子宫增大，宫腔内实质不均匀回声区，形态不规则，宫腔线消失。下列叙述错误的是
A. 最有可能的诊断是宫颈癌
B. 最有可能的诊断是子宫内膜癌
C. 分段刮宫是最可靠的诊断方法
D. 原发性输卵管癌可能性小
E. 临床上与绝经过渡期功血难以鉴别，应先行分段刮宫，确诊后再对症处理

正确答案：A。最有可能的诊断是宫颈癌

解析：患者为中年女性，45岁（绝经过渡期始于40岁，历时1～20年不等）处于绝经过渡期，阴道不规则出血2月（子宫内膜癌可表现为绝经过渡期月经紊乱），妇检可见子宫增大，稍软（晚期可有子宫增大），B超显示子宫增大，宫腔内有实质不均匀回声区，形态不规则，宫腔线消失（典型子宫内膜癌的超声图像有宫腔有实质不均匀回声区，或宫腔线消失，肌层内有不均匀回声区），最可能的诊断是子宫内膜癌（B对）。分段刮宫是最可靠的诊断方法（C对），临床上与绝经过渡期功血难以鉴别，应先行分段刮宫，确诊后再对症处理（E对）。宫颈癌（P306）（A错，为本题正确答案）的常见临床表现为接触性出血，即性生活或妇科检查后阴道流血，外生型可在宫颈口见赘生物，内生型表现为宫颈质硬、肥大，无子宫增大及宫腔影像学改变。原发性输卵管癌（P332）（D对）的典型临床表现为阴道排液、腹痛及盆腔肿块。